男，46岁，因双眼睑及四肢无力入院。入院诊断：重症肌无力。决定给予血浆置换治疗。在血浆置换过程中，患者出现面部瘙痒潮红，胸部及四肢出现少量荨麻疹。体检：体温37.6℃，血压115/65mmHg，该患者可能出现的输血反应为
A. 非溶血性发热性输血反应
B. 细菌污染反应
C. 过敏反应
D. 溶血性输血反应
E. 循环超负荷

正确答案：C。过敏反应

解析：患者血浆置换过程中出现面部瘙痒潮红、少量荨麻疹，应诊断为输血过敏反应（C对）。非溶血性发热性输血反应（A错）、细菌污染反应（B错）、溶血性输血反应（D错）均会出现高热，而不出现皮肤瘙痒、潮红与荨麻疹。循环超负荷（E错）常见于心功能低下、老年、幼儿及低蛋白血症病人，是由于输血过多、速度过快引起的，表现为突发的心率加快、呼吸急促、发绀、吐粉红色泡沫痰、肺内湿啰音等症状，一般也不出现荨麻疹。